粉末升华物可见黄色针状或羽状结晶的药材是
A. 牡丹皮
B. 斑蝥
C. 徐长卿
D. 大黄
E. 人参

正确答案：D。大黄

解析：本题考查的是中药的理化鉴别。粉末升华物可见黄色针状或羽状结晶的药材是大黄（D对）。微量升华：是利用中药中所含的某些化学成分在一定温度下能升华的性质，将所得升华物在显微镜下观察其结晶形状、颜色及化学反应作为鉴别特征。如大黄粉末升华物有黄色针状（低温时）、枝状和羽状（高温时）结晶，在结晶上加碱液则呈红色，可进一步确证其为蒽醌类成分。薄荷的升华物为无色针簇状结晶（薄荷脑），加浓硫酸2滴及香草醛结晶少许，显黄色至橙黄色，再加蒸馏水1滴即变紫红色。牡丹皮（A错）、徐长卿（C错）根的升华物为长柱状或针状、羽状结晶（丹皮酚）。斑蝥（B错）的升华物（在30℃～140℃）为白色柱状或小片状结晶（斑蝥素），加碱液溶解，再加酸又析出结晶。少数中成药制剂也能使用微量升华法进行鉴别，如大黄流浸膏（1味药）中鉴别大黄；万应锭（9味药）中鉴别胡黄连；牛黄解毒片（8味药）中鉴别冰片等。